某幼儿园发现一麻疹患儿。为了控制麻疹进一步蔓延，不应采取的措施是
A. 暂不接受其他易感儿入托
B. 整个幼儿园中小儿每天口服利巴韦林（三氮唑核苷）
C. 易感者接触麻疹后应隔离检疫3周
D. 体弱多病的易感儿应立即肌内注射丙种球蛋白
E. 体健易感儿接触后2天内应急接种麻疹疫苗

正确答案：B。整个幼儿园中小儿每天口服利巴韦林（三氮唑核苷）

解析：麻疹是一种由麻疹病毒引起的传染病，以下几种措施可以有效的预防该传染病的传播：易感者接触麻疹后应隔离检疫3周可控制传染源（C对）；暂不接受其他易感儿入托可以控制传染途径（A对）；体弱多病的易感儿应立即肌内注射丙种球蛋白（D对）和体健易感儿接触后2天内应急接种麻疹疫苗（E对）可以有效的保护易感人群。利巴韦林（三氮唑核苷）在体外对麻疹病毒有抑制作用，但体内疗效尚未公认，不易常规应用（见七版福堂实用儿科学）（B错，为本题正确答案）。